患者，男，14岁。患1型糖尿病2年，今日在家中用胰岛素治疗后突然出现昏迷。其昏迷原因最可能是
A. 高渗性昏迷
B. 酮症酸中毒
C. 乳酸性酸中毒
D. 低血糖昏迷
E. 急性脑血管病

正确答案：D。低血糖昏迷

解析：患者青少年男性，患1型糖尿病2年，今日在家中用胰岛素治疗后突然出现昏迷，其昏迷原因最可能是胰岛素应用过量导致的低血糖，进而昏迷（D对）。高渗性昏迷已严重高血糖、高血浆渗透压、脱水为特点，常见于急性感染、外伤、手术、脑血管意外等应激状态（A错）。酮症酸中毒以高血糖、酮症、酸中毒为主要表现，是胰岛素不足和拮抗胰岛素激素过多共同作用所致的严重代谢紊乱综合征（B错）。乳酸性酸中毒为糖尿病患者较少见而严重的并发症，临床表现常被掩盖，起病较急，有不明原因的深大呼吸、低血压、神志模糊、嗜睡、木僵及昏迷等症状，有时伴恶心、呕吐、腹痛，偶有腹泻，体温可下降（C错）。急性脑血管病多见于老年人，主要表现为猝然昏倒、不省人事、伴发口角歪斜、语言不利而出现半身不遂等症状（E错）。